营养液中脂肪乳提供的能量是
A. 200kcal
B. 450kcal
C. 700kcal
D. 1150kcal
E. 1550kcal

正确答案：B。450kcal

解析：本题考查肠外营养的配比计算。营养液中脂肪的含量=20%*250ml=50g，1g脂肪提供9kcal热量，营养液中脂肪提供的能量为50*9=450kcal（B对）。